斑蝥具抗癌作用的成分是
A. 蚁酸
B. 树脂
C. 色素
D. 斑蝥素
E. 脂肪油

正确答案：D。斑蝥素

解析：本题考查的是斑蝥的药理作用。斑蝥具抗癌作用的成分是斑蝥素（D对）。斑蝥主要含有斑蝥素、脂肪（E错）、树脂（B错）、蚁酸（A错）及色素（C错）等。斑蝥素是其有效成分，也是毒性成分。《中国药典》规定，斑蝥含斑蝥素不得少于0.35%。斑蝥中斑蝥素具有抗肿瘤作用，包括抗肺癌作用、抗肝癌作用、抗卵巢癌作用、抗胰腺癌作用、抗宫颈癌作用等。